患者男性，45岁，患风湿性心脏瓣膜病多年。现症见心悸气短，神疲乏力，咳嗽喘促，颧颊暗红，唇甲发绀，舌有瘀斑，脉细结代。其治法是
A. 泻肺利水
B. 温补心阳
C. 滋阴安神
D. 益气活血
E. 温阳利水

正确答案：D。益气活血

解析：男性，45岁，患风湿性心脏瓣膜病多年，气虚故见心悸气短，神疲乏力，咳嗽喘促；瘀血不行故见颧颊暗红，唇甲发绀，舌有瘀斑，脉细结代（D对）。水饮停肺型宜泻肺利水（A错）。心阳不足型宜温补心阳（B错）。阴虚血少，神志不安型宜滋阴安神（C错）。心肾阳虚证，症状：心悸，喘息不能平卧，颜面及肢体浮肿，或伴胸水、腹水，脘痞腹胀，形寒肢冷，大便溏泻，小便短少，舌体胖大，质淡，苔薄白，脉沉细无力或结代。治法：温补心肾，化气行水（E错）。